经常接触有机溶剂可使皮肤
A. 角化
B. 色素沉着
C. 溃疡
D. 皲裂
E. 皮疹

正确答案：D。皲裂

解析：本题考查职业有害因素对皮肤的损害。生产性毒物可对皮肤造成多种损害，如酸、碱、有机溶剂等所致接触性皮炎；沥青、煤焦油等所致光敏性皮炎；矿物油类、卤代芳烃化合物等所致职业性座疮；煤焦油、石油等所致皮肤黑变病；铬的化合物、铍盐等所致职业性皮肤溃疡；沥青、焦油等所致职业性疣赘；有机溶剂、碱性物质等所致职业性角化过度和皲裂（D对ABCE错）。